颈动脉搏动多见于
A. 二尖瓣关闭不全
B. 主动脉瓣关闭不全
C. 三尖瓣关闭不全
D. 肺动脉瓣关闭不全
E. 二尖瓣狭窄

正确答案：B。主动脉瓣关闭不全

解析：正常人颈部动脉的搏动，只在剧烈运动心搏出量增加时可见，且很微弱。病理状态下，颈动脉搏动多见于主动脉瓣关闭不全（B对）。二尖瓣关闭不全（A错）查体主要可见球形心，常闻及心尖区收缩期吹风样杂音，一般不会出现颈动脉搏动。三尖瓣关闭不全（C错）查体主要可见颈静脉搏动，常可闻及三尖瓣区收缩期吹风样杂音。肺动脉瓣关闭不全（D错）查体常可闻及肺动脉瓣区舒张期吹风样杂音。二尖瓣狭窄（E错）查体主要可见梨形心，常可闻及二尖瓣区舒张中晚期隆隆样杂音。